最易伤人阴位的六淫邪气是
A. 风邪
B. 暑邪
C. 燥邪
D. 湿邪
E. 寒邪

正确答案：D。湿邪

解析：本题考查的是湿邪的性质和致病特点。最易伤人阴位的六淫邪气是湿邪（D对）。湿邪的性质和致病特点：（1）湿为阴邪，易阻遏气机，损伤阳气。（2）湿性重浊。（3）湿性黏滞。（4）湿性趋下，易伤阴位。风邪（A错）的性质和致病特点：（1）风为阳邪，其性开泄，易袭阳位。（2）风邪善行而数变。（3）风为百病之长。暑邪（B错）的性质和致病特点：（1）暑为阳邪，其性炎热。（2）暑性升散，耗气伤津。（3）暑多挟湿。燥邪（C错）的性质和致病特点：（1）燥性干涩，易伤津液。（2）燥易伤肺。寒邪（E错）的性质和致病特点：（1）寒为阴邪，易伤阳气。（2）寒性凝滞，主痛。（3）寒性收引。